竞争性拮抗药的特点有
A. 使激动药的量效曲线平行右移
B. 与受体的亲和力用pA₂表示
C. 与受体结合亲和力小
D. 不影响激动药的效能
E. 内在活性较大

正确答案：A、B、D。使激动药的量效曲线平行右移；与受体的亲和力用pA₂表示；不影响激动药的效能

解析：本题考查竞争性拮抗药。竞争性拮抗药与受体的亲和力可用拮抗参数（pA₂）表示（B对），其含义是：在拮抗药存在时，若2倍浓度的激动药所产生的效应恰好等于未加入拮抗药时激动药的效应，则为所加入拮抗药的摩尔浓度的负对数值。竞争性拮抗药可使激动药的量效曲线右移（A对），但其最大效应不变（D对）。竞争性拮抗药具有较强的亲和力（C错），但缺乏内在活性（α=0）（E错）。